下列哪类激素主要用于贫血、再生障碍性贫血、老年性骨质疏松症治疗
A. 皮质激素类
B. 抗孕激素类
C. 雌激素类
D. 蛋白同化激素
E. 孕激素类

正确答案：D。蛋白同化激素

解析：本题考查蛋白同化激素的作用。蛋白同化激素（D对）临床可用于慢性消耗性疾病、骨质疏松、再生障碍性贫血，血小板减少症等。皮质激素类药物（A错）能够抑制炎症反应、减少组织损伤、稳定细胞内细胞器，以及减少水肿、出血、毒素吸收等。抗孕激素类（B错）主要通过抑制排卵达到避孕的目的。雌激素类（C错）则主要用于补充雌激素不足。孕激素（E错）对维持妊娠至关重要。